提出征四失论和疏五过论的著作是
A. 《黄帝内经》
B. 《伤寒杂病论》
C. 《备急千金要方》
D. 《本草纲目》
E. 《外科正宗》

正确答案：A。《黄帝内经》

解析：成书于战国时期的《黄帝内经》，不仅是我国第一部医书，而且还是我国第一部有专门论述医德内容的医书，在“疏五过论”、“徵四失论”和“师传”等篇章中对医德进行了专门的论述，是我国历史上最为重要的医德经典。“天覆地载，万物悉备，莫贵于人”的人命至重思想，“圣人不治已病治未病”的重视预防思想，“上知天文，下知地理，中知人事”的医生素质要求等丰富的医德思想（A对）。